膳食结构是指
A. 食物的化学组成
B. 居民平均每年消费的各种食物数量的总计
C. 食物内部的组织构造
D. 组成膳食的食物种类
E. 居民消费的食物种类及其数量的相对构成

正确答案：E。居民消费的食物种类及其数量的相对构成